铈量法中所用的指示液是
A. 结晶紫
B. 碘化钾-淀粉
C. 荧光黄
D. 酚酞
E. 邻二氮菲

正确答案：E。邻二氮菲

解析：本题考查铈量法。铈量法中所用的指示剂为邻二氮菲（E对）。铈量法是氧化还原滴定法的一种，以硫酸铈为滴定剂，以邻二氮菲为指示剂。结晶紫（A错）是非水碱量法的指示剂；碘化钾-淀粉（B错）是碘量法的指示剂；荧光黄（C错）是银量法的指示剂。酚酞（D错）是酸碱滴定法的指示剂。